男，35岁。阵发性心悸3年，发作时按摩颈动脉窦心悸可突然终止。发作时心电图示：心室率190次/分，逆行P波，QRS波群形态与时限正常。该患者最可能的诊断是
A. 心房颤动
B. 窦性心动过速
C. 房性期前收缩
D. 阵发性室性心动过速
E. 阵发性室上性心动过速

正确答案：E。阵发性室上性心动过速

解析：患者中年男性，阵发性心悸，颈动脉窦按摩心悸可突然终止（阵发性室上速常见治疗），心电图示:心室率190次/分，逆行P波，QRS波群形态与时限正常，均符合阵发性室上速的心电图表现，故该患者最可能的诊断是阵发性室上性心动过速（E对）。心房颤动（P188）（A错）的常见心电图表现为P波消失，代之以频率约350～600次/分的f波。窦性心动过速（P182）（B错）通常逐渐开始和终止，按摩颈动脉窦可使其频率减慢，但频率多在100～150次/分，P波形态正常，无逆行P波。房性期前收缩（P185）（C错）的P波提前发生，与窦性P波形态不同，但一般不会出现逆行P波。阵发性室性心动过速（P198）（D错）可阵发性发作，心室率通常在100～250次/分，但按摩颈动脉窦一般无效，P波正常，QRS波群形态畸形，多可见心室夺获与室性融合波。